腮腺炎病毒是流行性腮腺炎的病原体，感染者可引起
A. 肺炎
B. 肝炎
C. 肾炎
D. 脑膜炎
E. 睾丸炎或卵巢炎

正确答案：E。睾丸炎或卵巢炎

解析：腮腺炎病毒是流行性腮腺炎的病原体，只有一个血清型。感染者可引起睾丸炎、卵巢炎等并发症。掌握“正、副黏病毒”知识点。